患儿，6个月。母乳喂养，腹泻已两个半月，大便每日6～7次，便中含有奶瓣，曾服用妈咪爱无效。查体：神志清，体重6.3kg，化验：大便偶见脂肪滴。应首先考虑的诊断是
A. 大肠杆菌性肠炎
B. 霉菌性肠炎
C. 生理性腹泻
D. 病毒性肠炎
E. 过敏性肠炎

正确答案：C。生理性腹泻

解析：生理性腹泻：多见于6个月以内婴儿，外观虚胖，常有湿疹，生后不久即出现腹泻，除大便次数增多外，无其他症状，食欲好，不影响生长发育。近年来发现此类腹泻可为乳糖不耐受的一种特殊类型，添加辅食后，大便即转为正常（C对）。大肠杆菌性肠炎潜伏期一般为2～5天。起病一般较慢，也可急性起病。有饮食不调、添加辅食不当等诱因。轻症不发热，主要症状为腹泻，大便每天3～5次，呈黄色蛋花样带奶瓣，量多。病情继续发展则出现发热、呕吐、食欲缺乏、腹胀、中毒性肠麻痹。在出现肠麻痹前腹泻加重，可出现黏液血便。成人患者常急性起病，有脐周隐痛、腹鸣，偶有里急后重，表现为“痢疾样”（A错）。霉菌性肠炎大多发生在应用抗生素治疗后，轻者腹泻水样，重者水便中可见漂浮脱落的伪膜，甚至泻下血样便，每日可达10次以上。本病常继发于上消化道念珠菌病，可见“鹅口疮”，侵犯食道时还可见咽痛、吞咽困难、厌食、呕吐，甚至呕血。皮肤局部一般也有念珠菌感染、糜烂的征象。正常人患病有时仅有不明原因的腹泻，其他症状缺如或轻微。严重的患者念珠菌可扩散全身，引起其他呼吸、中枢神经组织的病变，以至出现败血症、休克等危急征候（B错）。病毒性肠炎一般起病急，主要临床表现为腹泻，排黄色水样便，无黏液及脓血，量多，多数伴有发热，患儿早期可能出现呼吸道症状。成人感染者发热及呼吸道症状较儿童少。其他并发症状有腹胀、腹鸣、腹痛和恶心、呕吐等。也可有全身乏力、酸痛、头晕、头痛等症状。腹泻重者可发生等渗性脱水、代谢性酸中毒和电解质紊乱（D错）。过敏性肠炎主要表现为腹痛、腹胀、腹泻、便秘、粘液便等，以腹痛和慢性腹泻为主要表现。腹痛以左下腹及下腹部为主，轻重不等，排便或排气后可缓解。大便次数增多，每日2～6次或更多，多为糊状便或稀便，但不带血。还有一些患者4～7天排便一次，大便干结，排便困难。此外，可有上消化道症状如上腹不适、嗳气、反酸、烧心等（E错）。